（133～134题共用题干）男，25岁。腰背部疼痛8年，晨起明显，活动后减轻。近1个月腰痛加重，活动受限。查体：腰椎前屈、后伸受限，Schober试验（+），双侧“4”字试验（+）。最有可能的诊断是
A. 类风湿关节炎
B. 痛风关节炎
C. 风湿性关节炎
D. 反应性关节炎
E. 强直性关节炎

正确答案：E。强直性关节炎

解析：患者男，25岁（为强直性关节炎的好发人群），有腰背部疼痛8年病史，晨起明显，活动后减轻，活动受限（为强直性脊柱炎的特征性临床表现）。查体：腰椎前屈、后伸受限，Schober试验（+），双侧“4”字试验（+），提示有骶髂关节病变。结合该患者病史、临床表现、体查，该患者诊断考虑为强直性关节炎（E对）。类风湿关节炎（A错）女性多发，很少有骶髂关节病变，只侵犯颈椎，为多关节、对称性，四肢大小关节均可发病。痛风关节炎（B错）多有遗传因素和家族因素，好发于40岁以上的男性。风湿性关节炎（C错）起病较急，受累关节以大关节为主，开始侵及下肢关节者占85%，膝和踝关节最为常见，常在数日内自行消退，不留后遗症，但常反复发作。反应性关节炎（D错）是以关节炎、尿道炎和结膜炎三联征为临床特征的一种特殊临床类型，常表现为突发性急性关节炎并且伴有独特的关节外皮肤粘膜症状。